关于局部麻醉药的不良反应正确的是
A. 中枢神经系统的兴奋症状
B. 引起小动脉扩张
C. 对心肌有抑制作用
D. 可抑制中枢神经系统
E. 以上都是

正确答案：E。以上都是